不断有钙盐沉积，并逐渐钙化为坚实的骨组织是在
A. 血肿形成
B. 血肿机化
C. 骨痂形成
D. 骨痂改建
E. 骨折线愈合

正确答案：D。骨痂改建

解析：骨痂改建：骨折2周后，骨样组织内不断有钙盐沉积，并逐渐钙化为坚实的骨组织，与骨折断端的骨组织连接、融合在一起。掌握“颧骨及颧弓、眼眶骨折及骨折愈合过程”知识点。